1岁以内婴儿每天每公斤所需总能量约为
A. 70kcal
B. 90kcal
C. 110kcal
D. 130kcal
E. 150kcal

正确答案：C。110kcal

解析：＜6月龄婴儿能量平均需要量为90kcal（376.56kJ）/（kg·d），7～12月龄为80kcal（334.72kJ）/（kg·d），但老数据中，婴儿能量需要约为110kcal/（kg·d）（C对）。所以本题依照原来的数据选择C，但根据第九版儿科学，需要牢记＜6月龄婴儿能量平均需要量为90kcal（376.56kJ）/（kg·d），7～12月龄为80kcal（334.72kJ）/（kg·d）。